初级卫生保健工作包括以下方面
A. 社区康复
B. 促进健康和预防保健
C. 合理治疗
D. 以上全是

正确答案：D。以上全是

解析：本题考查初级卫生保健的工作。初级卫生保健工作包括以下方面：促进健康、预防保健、合理治疗、社区康复（D对ABC错）。